集体单位中突然出现大量相同患者为
A. 暴发
B. 流行
C. 散发
D. 大流行
E. 有季节性

正确答案：A。暴发

解析：暴发指在一个局部地区或集体单位中，短时间内，突然出现大量相同患者的现象。掌握“流行病学资料与疾病分布”知识点。